分离汉防己甲素和汉防己乙素的原理是
A. 氮原子的杂化方式不同
B. 在碳酸氢钠溶液中的溶解度不同
C. 盐酸盐的溶解度不同
D. 极性的大小不同
E. 分子内氢键的不同

正确答案：D。极性的大小不同

解析：本题考查的是防己主要生物碱及其化学结构。分离汉防己甲素和汉防己乙素的原理是极性的大小不同（D对）。防己的有效成分为生物碱，总生物碱含量可达2.3%～5%，其中汉防己甲素（粉防己碱），约为1%，汉防己乙素（防己诺林碱）约为0.5%。《中国药典》以粉防己碱和防己诺林碱为指标成分进行含量测定，对药材要求两者总量不得少于1.6%；对饮片要求两者总量不得少于1.4%。由于两者分子结构中7位取代基的差异，前者为甲氧基，极性小；后者为酚羟基，极性较大。可根据极性差异对两者进行分离。